根据国内标准，血红蛋白测定值下列哪项可诊断为贫血
A. 妊娠期低于105g/L
B. 成年女性低于110g/L
C. 哺乳期低于115g/L
D. 成年男生低于130g/L
E. 初生儿至3个月低于150g/L

正确答案：B。成年女性低于110g/L

解析：我国血液病学家认为在我国海平面地区，成年男性Hb小于120g/L，成年女性（非妊娠）Hb小于110g/L，孕妇Hb小于100g/L，就是贫血。掌握“贫血概论及缺铁性贫血”知识点。